到现在为止，我国已开展过全国范围的卫生服务总调查的次数是
A. 1次
B. 3次
C. 2次
D. 4次
E. 5次

正确答案：C。2次

解析：本题考查我国目前开展过全国范围的卫生服务总调查的次数。到现在为止，我国已开展过全国范围的卫生服务总调查的次数是2次（C对ABDE错）。